以下能够抗肝炎病毒的药物是
A. 利巴韦林
B. 青霉素
C. 青蒿素
D. 糖皮质激素
E. 碳酸锂

正确答案：A。利巴韦林

解析：以上药物中，只有利巴韦林是抗病毒药物。掌握“氟康唑、利巴韦林及阿昔洛韦”知识点。